真性分流是指
A. 部分肺泡通气不足
B. 部分肺泡血流不足
C. 肺泡完全不通气但仍有血流
D. 部分肺泡完全无血流但仍有通气
E. 肺泡通气和血流都不足

正确答案：C。肺泡完全不通气但仍有血流

解析：真性分流是指肺泡完全不通气但仍有血流（C对）。